提高病人依从性的方法不包括
A. 及时纠正病人的不良行为
B. 纠正病人对检查和治疗措施的错误认识
C. 建立融洽的医患关系
D. 提高病人对医嘱的理解和记忆程度
E. 教会病人自我监测

正确答案：A。及时纠正病人的不良行为